不属于物理化学靶向制剂的是
A. 磁性靶向制剂
B. 栓塞靶向制剂
C. 热敏靶向制剂
D. 免疫靶向制剂
E. pH敏感靶向制剂

正确答案：D。免疫靶向制剂

解析：本题考查靶向制剂。不属于物理化学靶向制剂的是免疫靶向制剂（D错，为本题正确答案）。物理化学靶向制剂包括磁性靶向制剂（A对）、栓塞性靶向制剂（B对）、热敏性靶向制剂（C对）、pH敏感的靶向制剂（E对）。